有关乳牙早萌说法正确的是
A. 多见于上颌中切牙
B. 牙釉质、牙本质厚
C. 早萌牙脱落容易误吸气管
D. 早萌牙一般稳固
E. 早萌牙不会影响吸吮

正确答案：C。早萌牙脱落容易误吸气管

解析：乳牙早萌多见于下颌中切牙。诞生牙多数是正常牙，少数是额外牙。早萌牙极度松动，牙釉质、牙本质薄并钙化不良。早萌牙常影响吸吮。舌系带摩擦下切牙可形成创伤性溃疡。极松的早萌牙自行脱落容易误吸入气管。掌握“乳牙滞留和乳牙早萌”知识点。